40岁男性，腰痛伴右下肢放射痛2月，反复发作，与劳累有关，咳嗽，用力排便时可加重疼痛。查体右直腿抬高试验40°阳性，加强试验阳性，X线片示：L4～5椎间隙变窄。可完全排除的诊断是
A. 腰椎结核
B. 腰肌劳损
C. 腰椎肿瘤
D. 脊椎滑脱症
E. 腰椎管狭窄症

正确答案：B。腰肌劳损

解析：腰肌劳损（B错，为本题正确答案）为腰部肌肉及其附着点筋膜或骨膜的慢性损伤性炎症，无明显诱因的慢性疼痛为其主要症状，休息后可缓解。直腿抬高试验阴性，下肢无神经受累表现（即无下肢放射性疼痛），故可完全排除诊断。腰椎结核（A对）、腰椎肿瘤（C对）、脊椎滑脱症（D对）、腰椎管狭窄症（E对）等可以有脊髓、马尾神经或神经根受压刺激的神经受累表现，如下肢放射痛，故无法排除。